龈沟液的作用
A. 冲洗龈沟内的外来物质
B. 具有抗菌作用
C. 含有丰富的血浆蛋白
D. 提供牙石矿化的无机成分
E. 以上都是

正确答案：E。以上都是

解析：本题考查龈沟液的作用。龈沟液的作用有：冲洗龈沟内的外来物质（A对），健康牙龈中少量的龈下菌斑微生物产生一定量的大分子产物，这些产物可扩散而聚集于基底膜处，从而产生持续的渗透梯度，形成龈沟液流，冲洗外来物质。具有抗菌作用（B对），龈沟液中具有抗微生物的特异性抗体，白细胞是龈沟液中的重要防御细胞，具有吞噬和杀菌能力。含有丰富的血浆蛋白（C对），龈沟液中含有可以促进上皮附着于牙面的血浆蛋白。牙龈防御机制中所含补体可促进抗体的活化。提供龈下细菌丰富的营养成分。提供牙石矿化的无机成分（D对）。（ABCD均对，故E为本题的正确答案）。